通过细胞膜的主动变形将药物摄入细胞内或从细胞内部释放到细胞外的过程属于
A. 酶诱导作用
B. 膜动转运
C. 血脑屏障
D. 肠肝循环
E. 蓄积作用

正确答案：B。膜动转运

解析：本题考查药物的转运方式。膜动转运（B对）是指生物膜通过主动变形将某些物质摄入细胞内或从细胞内释放到细胞外；酶诱导作用（A错）是指有些化学物质能提高肝药酶活性，使一些药物代谢速率加快；血脑屏障（C错）是脑毛细血管壁与神经胶质细胞形成的血浆与脑细胞之间的屏障和由脉络丛形成的血浆和脑脊液之间的屏障；肠肝循环（D错）是指随胆汁排入十二指肠的药物或其代谢物，在肠道中重新被吸收，经门静脉返回肝脏，重新进入血液循环的现象；蓄积作用（E错）指药物对某些组织亲和性不同，有些药物在组织中停留时间长，返回血液循环的速度慢，当连续应用该药物时，组织中的药物浓度逐渐升高。